现代研究表明，鹿茸的主要药理作用有
A. 抗疲劳
B. 延缓衰老
C. 促进成长发育
D. 增强免疫功能
E. 增强骨骼造血功能

正确答案：A、B、C、D、E。抗疲劳；延缓衰老；促进成长发育；增强免疫功能；增强骨骼造血功能

解析：本题考查的是鹿茸的药理作用。现代研究表明，鹿茸的主要药理作用有抗疲劳（A对）、延缓衰老（B对）、促进成长发育（C对）、增强免疫功能（D对）、增强骨骼造血功能（E对）。鹿茸性温而不燥，具有振奋和提高机体功能，对全身虚弱、久病之后患者，有较好的保健作用。鹿茸可以提高机体的细胞免疫和体液免疫功能，促进淋巴细胞的转化，具有免疫促进剂的作用。它能增加机体对外界的防御能力，调节体内的免疫平衡，从而避免疾病发生和促进创伤愈合、病体康复，从而起到强壮身体、抵抗衰老的作用。